男性，40岁，渔民。因发热1周伴腹痛、腹胀、腹泻，大便每日3~4次，稀便有黏冻，村卫生室给服氯霉素5天，患者热退，症状好转，继续工作，2周后再次发热，体温39℃，抽血培养有伤寒杆菌生长。这提示患者可能是
A. 伤寒复发
B. 初发作伤寒
C. 再燃
D. 带菌者
E. 迁延型伤寒

正确答案：A。伤寒复发